为了使药用作用与胆固醇合成高峰期同步，调节血脂药普伐他汀宜于
A. 早晨服用
B. 餐后
C. 餐前
D. 睡前
E. 空腹

正确答案：D。睡前

解析：本题考查药品服用的适宜时间。为了使药用作用与胆固醇合成高峰期同步，调节血脂药普伐他汀宜于睡前服用（D对）。适宜早晨（A错）服用的药有糖皮质激素类、抗高血压药、抗抑郁药、利尿药等。适宜餐后（B错）服用的药有非甾体抗炎药、维生素和组胺H₂受体阻断剂。适宜餐前（C错）服用的药有胃黏膜保护药、收敛药、促胃动力药。适宜空腹（E错）服用的药有钙磷调节药、抗菌药物和广谱抗线虫药。